《药品管理法》规定对四类药品实行特殊管理，下列药品中，不属于法定特殊管理药品的是
A. 生化药品
B. 麻醉药品
C. 精神药品
D. 放射性药品
E. 医疗用毒性药品

正确答案：A。生化药品

解析：《药品管理法》规定，国家对麻醉药品（B对）、精神药品（C对）、医疗用毒性药品（E对）、放射性药品（D对），实行特殊管理。生化药品不属于法定特殊管理药品（A错，为本题正确答案）。